GMP要求食品生产企业确保终产品的质量符合标准，其制定单位不包括
A. 国家政府机构（如FDA）
B. 行业组织
C. 食品企业
D. 食品供应单位
E. 食品生产单位

正确答案：D。食品供应单位